利用现有最好的证据制定关于个体患者的诊治方案属于
A. 系统综述
B. meta分析
C. 循证医学
D. 循证医疗卫生决策
E. 临床实践指南

正确答案：C。循证医学

解析：本题考查循证医学。循证医学（C对ABDE错）是有意识地、明确地、审慎地利用现有最好的证据制定关于个体患者的诊治方案。